手太阳小肠经的郄穴是
A. 会宗
B. 梁丘
C. 养老
D. 阳交
E. 金门

正确答案：C。养老

解析：手太阳小肠经郄穴为养老（C对）。会宗为手少阳三焦经的郄穴（A错 ）。梁丘为 足阳明胃经的郄穴（B错）。阳交为阳维脉的郄穴（D错）。金门为足太阳膀胱经的郄穴（E错）。